1982年某市为了调查老年人多发病的分布情况，对该市7个区的9个不同地段抽取60岁及以上的老年6393例进行调查。该调查可计算
A. 发病率
B. 患病率
C. 罹患率
D. 发病专率
E. 存活率

正确答案：B。患病率

解析：本题考查患病率的应用。患病率（B对ACDE错）通常用来反映疾病的现患状况。调查老年人多发病的分布情况可以获得现患资料，计算多发病的当前患病率。